某地人口为300万，过去几年每年发生伤害患者30例，而某年的发病率为10/10万，这种情况称为
A. 暴发
B. 散发
C. 流行
D. 大流行
E. 世界大流行

正确答案：C。流行

解析：本题考查流行的概念。流行（C对ABDE错）是指在某地区某病的发病率显著超过该病历年发病率水平。往年发病率为1/10万，某年为10/10万，远高于历年正常水平，属于流行。